下述哪一过程不是致癌作用的三个阶段
A. 突变
B. 引发
C. 促进
D. 进展

正确答案：A。突变

解析：本题考查致癌作用的三个阶段。致癌的过程大致分为引发（B对）、促长（C对）、进展（D对）三个阶段。突变（A错，为本题正确答案）不是致癌作用的阶段。